下列哪项不是闭经与痛经的共同病机
A. 气血虚弱
B. 气滞血瘀
C. 肺肾阴虚
D. 肝肾不足
E. 寒凝血瘀

正确答案：C。肺肾阴虚

解析：闭经的病机有肝肾不足、气血虚弱、阴虚血燥、痰湿阻滞、气滞血瘀、寒凝血瘀。 痛经的病机有气滞血瘀、寒凝血瘀、湿热瘀阻、气血虚弱、肝肾亏损（ABDE对）（C错，为本题正确答案）。